流行性脑脊髓膜炎的主要传播方式是
A. 飞沫直接从空气传播
B. 密切接触间接传播
C. 通过消化道传播
D. 通过日常生活用品等间接传播
E. 通过吸血节肢动物传播

正确答案：A。飞沫直接从空气传播

解析：病原菌主要通过咳嗽、喷嚏等飞沫直接从空气中传播（A对）。因病原体在体外生存力极弱，故密切接触间接传播（B错）机会很少，仅对免疫系统还不完善的2岁以下婴幼儿有意义。通过消化道传播（C错）、吸血节肢动物传播（E错）机会少。通过日常生活用品等间接传播（D错）机会很少。